患儿，男，2岁。身高70cm，智力低下，鼻梁低，舌体厚大，腹胀，便秘，有脐疝。最有明确诊断价值的检查是
A. TSH、T₄
B. 结肠镜检
C. 甲状腺B超
D. 尿三氯化铁
E. 染色体

正确答案：A。TSH、T₄

解析：2岁男孩（多数先天性甲状腺功能减低症在出生半年以后出现典型症状），身高70cm（身高矮小是生长发育迟缓的表现，正常身高约为90cm），智力低下（先天性甲状腺功能减低症的神经系统症状），鼻梁低，舌体厚大（先天性甲状腺功能减低症的特殊面容），腹胀，便秘（生理功能低下的表现），有脐疝（甲状腺功能减退症常伴有脐疝），综合患儿的症状和体征，最可能的诊断是先天性甲状腺功能减低症，故为明确诊断，应检测血清T₄、TSH浓度（A对），如T₄降低、TSH明显升高即可确诊。结肠镜检（B错）用于先天性巨结肠、结肠息肉、结肠肿块等的辅助检查。甲状腺B超（C错）用于甲状腺结节、甲状腺囊性变等的辅助检查，对甲状腺功能检测没有意义。尿三氯化铁（D错）试验用于苯丙酮酸尿症的筛查。染色体检查（E错）主要用于染色体遗传病如21-三体综合征、5P-综合征等的确诊。